关于幽门螺杆菌的生物学性状正确的是
A. 无鞭毛
B. 革兰染色阳性
C. 营养要求低
D. 微需氧
E. 呈球形

正确答案：D。微需氧